女，28岁，经产妇，人工流产2次。妊娠37周，晨起发现阴道流血，多于月经量，无腹痛。查体：P80次/分，BP110/70mmHg，胎方位LOA，头浮，胎心率150次/分，耻骨联合上可闻及血管音。最可能的诊断是
A. 先兆临产
B. 胎盘早剥
C. 子宫破裂
D. 前置胎盘
E. 先兆早产

正确答案：D。前置胎盘

解析：成年女性患者，经产妇，有多次流产史的高危因素。妊娠晚期（妊娠28周～40周），今起发现阴道流血，多于月经量，无腹痛。查体：血压下降，BP110/70mmHg（正常值90～120/60～80mmHg），胎位异常，头浮（提示胎先露），耻骨联合上可闻及血管音。综合患者的症状、体征和辅助检查，最可能的诊断是前置胎盘（D对）。先兆临产（A错）主要表现为不规律宫缩、胎儿下降感以及阴道少量淡血性分泌物。胎盘早剥（B错）常伴有妊娠期高血压疾病史或外伤史，子宫呈板状硬，阴道流血特征为陈旧不凝血。子宫破裂（C错）主要表现为胎儿窘迫。先兆早产（E错）为妊娠满28周至不足37周。